男，50岁，1周来右侧后牙咬物不适，冷水引起疼痛。近2日来，夜痛影响睡眠，并引起半侧头、面部痛，痛不能定位。检查时见右侧上、下第一磨牙均有咬合面龋洞。为确定牙位进行的一项检查是
A. 探诊
B. 叩诊
C. 松动度检查
D. 温度测验
E. X线片检查

正确答案：D。温度测验

解析：本题考查急性牙髓炎的诊断要点。患者做检查是为了帮助确定患牙的位置，牙髓温度测验（D对）是根据患牙对冷或热刺激的反应来判断牙髓状态的一种诊断方法，可以帮助定位患牙。因患者有剧烈自发痛，探诊（A错）、叩诊（B错）及松动度检查（C错）都不能对患牙进行准确定位，X线片（E错）可以发现龋坏的牙齿，但并不能确定哪颗是引起疼痛的患牙。